药学职业道德范畴中的共同理想是指
A. 生活理想
B. 职业理想
C. 道德理想
D. 个人理想
E. 社会理想

正确答案：B。职业理想

解析：本题考查药学职业道德范畴中的共同理想。药学职业道德范畴中的共同理想是指职业理想（B对）。在内容上，理想分为社会理想（B错）和个人理想（D错）。在社会理想中分为共同理想和最高理想；在个人理想中又包含着生活理想（A错）、职业理想和道德理想（C错）。理想在层次上分为最高理想和共同理想。在目标上又可分为专业理想和成才理想。职业理想是理想结构中的重要组成部分，是职业道德的反映。